莪术醇是
A. 黄酮类化合物
B. 香豆素类化合物
C. 倍半萜类化合物
D. 二萜类化合物
E. 木脂素类化合物

正确答案：C。倍半萜类化合物

解析：本题考查的是倍半萜。莪术醇是倍半萜类化合物（C对）。倍半萜类化合物：倍半萜类是由3个异戊二烯单位构成的天然萜类化合物。倍半萜及其含氧化合物多与单萜类共存于植物挥发油中，是挥发油高沸程（250℃～280℃）的主要组分，也有低沸点的固体。在植物界中多以醇、酮、内酯或苷的形式存在。如香茅草、橙花、玫瑰等中金合欢醇（法尼醇）；青蒿（黄花蒿）中的青蒿素；马桑毒素；羟基马桑毒素；莪术中的莪术醇等。黄酮类化合物（A错）广泛存在于自然界中，多存在于高等植物及羊齿类植物中。主要有黄芩苷、黄芩素、大豆素、葛根素、槲皮素、芦丁、橙皮苷、杜鹃素等。香豆素类化合物（B错）是邻羟基桂皮酸的内酯。香豆素分可为五大类，即简单香豆素类、呋喃香豆素类、吡喃香豆素类、异香豆素类及其他香豆素类。（一）简单香豆素类：如伞形花内酯、茵芋苷。（二）呋喃香豆素类：补骨脂内酯，如香柑内酯、花椒毒内酯、欧前胡内酯、紫花前胡内酯等；白芷内酯，如异香柑内酯、茴芹内酯。（三）吡喃香豆素类：花椒内酯，如美花椒内酯；邪蒿内酯，如沙米丁和维斯纳丁；别美花椒内酯；狄佩它妥内酯。（四）异香豆素类：如茵陈炔内酯、仙鹤草内酯等。（五）其他香豆素类：如沙葛内酯、黄檀内酯等。二萜类化合物（D错）：是指骨架由4个异戊二烯单位构成，含20个碳原子的一类萜类衍生物。绝大多数不能随水蒸气蒸馏。二萜多以树脂、内酯或苷等形式广泛存在于自然界。不少二萜含氧衍生物具有很好的生物活性，如穿心莲内酯、芫花酯、雷公藤内酯、银杏内酯、紫杉醇等。木脂素类化合物（E错）木脂素类多数是游离的，也有少量与糖结合成苷而存在，由于较广泛地存在于植物的木部和树脂中，或开始析出时呈树脂状，故称木脂素。主要有五味子醇、五味子素、厚朴酚、和厚朴酚、连翘苷等。